为预防胎儿发生神经管畸形，孕期应补充叶酸，开始补充的时间应在
A. 孕前3个月
B. 孕后1个月
C. 孕后2个月
D. 孕后3个月
E. 分娩前1个月

正确答案：A。孕前3个月

解析：本题考查孕期营养的相关内容。叶酸有助于胎儿神经系统发育，建议准备怀孕的妇女在孕前3个月（A对BCDE错）和早孕3个月连续每日服用0.4mg叶酸。